来源于T淋巴细胞的淋巴瘤类型是
A. 边缘区淋巴瘤
B. Burkitt淋巴瘤
C. 间变性大细胞淋巴瘤
D. 套细胞淋巴瘤
E. 滤泡性淋巴瘤

正确答案：C。间变性大细胞淋巴瘤

解析：来源于T淋巴细胞的淋巴瘤类型有间变性大细胞淋巴瘤（C对）、原发性皮肤间变性大细胞淋巴瘤、蕈样肉芽肿/Sézary综合征、扭曲性淋巴细胞淋巴瘤等（记忆为“大S”）。边缘区淋巴瘤（A错）、Burkitt淋巴瘤（B错）、套细胞淋巴瘤（D错）、滤泡性淋巴瘤（E错）是来源于B淋巴细胞的淋巴瘤类型。